人体血液中的氟主要存在于
A. 酶
B. 血浆
C. 激素
D. 无机盐
E. 红细胞

正确答案：B。血浆

解析：人体血液中75%的氟存在于血浆中，其余的主要存在于红细胞。掌握“人体氟摄入及代谢、氟防龋”知识点。